方中先煎葛根使“解肌之力伏，而清中之气锐”的方剂是
A. 参苏饮
B. 葛根芩连汤
C. 葛根汤
D. 柴葛解肌汤
E. 升麻葛根汤

正确答案：B。葛根芩连汤

解析：葛根芩连汤中葛根解肌退热，升脾胃清阳而止泻，其先煮葛根使“解肌之力伏而清中之气锐”（B对）。参苏饮，葛根汤，柴葛解肌汤，升麻葛根汤中葛根与其它药同煎（ACDE错）。